药物增生牙龈切除术及牙龈成形术非适应症除外的是
A. 未进行牙周基础治疗，牙周炎症未消除者
B. 深牙周袋，袋底超过膜龈联合
C. 后牙区中等深度的骨上袋，袋底不超过膜龈联合，附着龈宽度足够者
D. 牙槽骨缺损及牙槽骨形态不佳，需行骨手术者
E. 前牙的牙周袋，牙龈切除术会导致牙根暴露，影响美观

正确答案：C。后牙区中等深度的骨上袋，袋底不超过膜龈联合，附着龈宽度足够者

解析：药物增生牙龈切除术及牙龈成形术非适应证：①未进行牙周基础治疗，牙周炎症未消除者。②深牙周袋，袋底超过膜龈联合。③牙槽骨缺损及牙槽骨形态不佳，需行骨手术者。④前牙的牙周袋，牙龈切除术会导致牙根暴露，影响美观。掌握“药物性牙龈肥大”知识点。